关于中药饮片管理的说法错误的是
A. 医疗机构临方炮制中药饮片应当持有医疗机构制剂许可证
B. 生产中药饮片必须持有药品生产许可证
C. 批发零售中药饮片必须持有药品经营许可证
D. 药品零售企业的中药调剂人员应具有中药学中专以上学历或者是具备中药调剂员资格

正确答案：A。医疗机构临方炮制中药饮片应当持有医疗机构制剂许可证

解析：本题考查中药饮片管理。医院进行临方炮制，应当具备与之相适应的条件和设施，严格遵照国家药品标准和省（区、市）药品监督管理部门制定的炮制规范炮制，并填写“饮片炮制加工及验收记录”，经医院质量检验合格后方可投入临床使用（A错，为本题正确答案）。医院对中药饮片调剂和临方炮制要符合国家有关规定。医院进行临方炮制，应当具备与之相适应的条件和设施，严格遵照国家药品标准和省（区、市）药品监督管理部门制定的炮制规范炮制，并填写“饮片炮制加工及验收记录”，经医院质量检验合格后方可投入临床使用。生产中药饮片必须持有《药品生产许可证》（B对），应当遵守药品生产质量管理规范；必须以中药材为起始原料，使用符合药用标准的中药材（购进未实施审批管理的中药材除外），并应尽量固定药材产地；必须严格执行国家药品标准和地方中药饮片炮制规范、工艺规程；必须在符合药品GMP条件下组织生产，出厂的中药饮片应检验合格，并随货附纸质或电子版的检验报告书。批发零售中药饮片必须持有《药品经营许可证》（C对），遵守药品经营质量管理规范，建立健全药品经营质量管理体系，保证药品经营全过程持续符合法定要求。中药饮片调剂人员应当具有中药学中专以上学历或者具备中药调剂员资格（D对）。